消化不良患者宜选用
A. 小檗碱
B. 阿苯达唑
C. 乳果糖
D. 干酵母
E. 硫糖铝

正确答案：D。干酵母

解析：本题考查药物的适应证。消化不良患者宜选用干酵母（D对）。助消化药有干酵母（酵母片）、乳酶生、复方乳酸菌胶囊，胰酶片（或多酶片）、胃蛋白酶、复方消化酶胶囊等。小檗碱（A错）主要用于感染性腹泻、细菌性痢疾等。阿苯达唑（B错）为广谱驱虫药。乳果糖（C错）为渗透性泻药。硫糖铝（E错）是黏膜保护药，临床主要用于胃和十二指肠溃疡。